被测药物与滴定剂的摩尔比为：提取分离后用非水溶液滴定法测定硫酸奎宁片的含量
A. 1∶1
B. 1∶2
C. 1∶3
D. 1∶4
E. 3∶2

正确答案：D。1∶4